用于慢性心功能不全的药物是
A. 地高辛
B. 奎尼丁
C. 两者皆有效
D. 两者皆无效

正确答案：A。地高辛

解析：本题考查用于慢性心功能不全的药物。地高辛（A对）用于慢性心功能不全。慢性心功能不全也称充血性心力衰竭，地高辛通过抑制衰竭心肌细胞膜上Na⁺，K⁺-ATP酶，使细胞内Na⁺水平升高，促进Na⁺-Ca²⁺交换，提高细胞内Na⁺水平，发挥正性肌力作用。奎尼丁为钠通道阻滞剂，为广谱抗心律失常药，无治疗慢性心功能不全作用（BCD错）。